患者，女，35岁，复杂部分发作性癫痫病史12年，最初使用苯妥英钠单药治疗，6个月前因癫痫控制不佳提高苯妥英钠剂量，因不能耐受不良反应换用卡马西平联合丙戊酸钠治疗，癫痫得到控制。患者近期出现体重增加及严重脱发，到神经内科复诊。患者同时患有2型糖尿病，长期口服二甲双胍、阿卡波糖治疗。此外患者长期服用复合维生素B。患者在使用丙戊酸钠时应监测血药浓度，适宜的血药浓度范围是
A. 4～12㎍/ml
B. 10～20㎍/ml
C. 50～150㎍/ml
D. 10～40㎍/ml
E. 150～200㎍/ml

正确答案：C。50～150㎍/ml

解析：本题考查丙戊酸钠。丙戊酸钠适宜的血药浓度范围是50～150㎍/ml（C对）。